逐瘀通脉胶囊的使用注意事项有
A. 体虚者忌用
B. 过敏体质者慎用
C. 脑出血患者禁用
D. 肝肾功能不全者忌用
E. 脑梗死急性期禁用

正确答案：A、C、D。体虚者忌用；脑出血患者禁用；肝肾功能不全者忌用

解析：本题考查的是逐瘀通脉胶囊的注意事项。逐瘀通脉胶囊的使用注意事项有体虚者忌用（A对）、脑出血患者禁用（C对）、肝肾功能不全者忌用（D对）。逐瘀通脉胶囊：【注意事项】孕妇禁用。脑出血患者禁用。体虚者、肝肾功能不全者忌用。脑梗死急性期应与一般综合治疗结合使用（E错）。正天丸：【注意事项】婴幼儿、孕妇、哺乳期妇女、肾功能不全者及对本品过敏者禁用。高血压、心脏病患者及过敏体质者慎用（B错）。不宜过量或长期服用。宜饭后服用。服药期间，忌烟酒及辛辣、油腻食物。